能传导咀嚼压力到牙槽嵴黏膜上并起支持固位作用的是
A. （牙合）支托
B. 卡臂尖
C. 人工牙
D. 基托
E. 连接杆

正确答案：D。基托

解析：基托的功能：①排列人工牙，连接义齿各部件成一个整体。②承担、传递和分散人工牙承受的（牙合）力。③修复缺损的牙槽骨、颌骨和软组织。④利用基托与黏膜之间的吸附力，基托与基牙及邻近牙接触形成的摩擦力和约束力，加强义齿的固位与稳定。也有防止义齿旋转和翘动的间接固位作用。掌握“局部义齿人工牙及基托”知识点。